西替利嗪的药理作用包括
A. 抑制组胺介导的早期变态反应
B. 抑制淋巴细胞增殖
C. 抑制炎症细胞移行及介质释放
D. 抑制巨噬细胞吞噬
E. 抑制自然杀伤细胞分化

正确答案：A、C。抑制组胺介导的早期变态反应；抑制炎症细胞移行及介质释放

解析：本题考查西替利嗪的药理作用。西替利嗪是选择性较高的H₁受体阻断剂，能稳定肥大细胞，抑制组胺介导的早期变态反应（A对），又能抑制炎症细胞移行及介质释放（C对）。